干姜的功效是
A. 温阳利水
B. 补火助阳
C. 疏肝燥湿
D. 下气降逆
E. 温肺化饮

正确答案：E。温肺化饮

解析：本题考查的是干姜的功效。干姜的功效是温肺化饮（E对）。干姜：【功效】温中，回阳，温肺化饮。附子：【功效】回阳救逆，补火助阳（B错），散寒止痛。吴茱萸：【功效】散寒止痛，疏肝下气，燥湿（C错）止泻。功效为温阳利水（A错）或下气降逆（D错）的中药，2022年考试指南未明确说明。